下列哪项不符合由胃泌素瘤引起的消化性溃疡
A. 多发生在球后十二指肠降部和横段，或空肠近端
B. 常规胃手术后不易复发
C. 易并发出血穿孔梗阻
D. 基础胃酸分泌过度
E. 常伴腹泻

正确答案：B。常规胃手术后不易复发

解析：胃泌素瘤又称为Zollinger-Ellison综合征，是以多发、顽固及不典型部位消化性溃疡及腹泻为特征的临床综合征。肿瘤分泌的大量胃泌素可刺激胃壁细胞增生和大量胃酸分泌，导致基础胃酸分泌过度（D对）。大量酸性胃液进入小肠，脂肪酶在酸性环境中失活，脂肪不能充分分解，吸收障碍，导致腹泻（E对）。除了在常见部位发生溃疡以外，还可发生在不典型部位（食管下段、十二指肠降段、水平段、升段、甚或空肠上端及胃大部切除后的吻合口）（A对）。本病消化性溃疡常并发出血、穿孔、内科常规治疗常无显著疗效（C对），在进行常规胃手术后极易复发（B错，为本题正确答案）。